根据《城镇职工基本医疗保险定点零售药店管理暂行办法》的表述，错误的是
A. 定点零售药店应配备专（兼）职管理人员
B. 定点零售药店应与药品监督管理部门的电脑联网
C. 对外配处方要分别管理
D. 对外配处方要单独建账
E. 定点零售药店要定期向统筹地区社会保险经办机构报告处方外配服务及费用发生情况

正确答案：B。定点零售药店应与药品监督管理部门的电脑联网